下列处方中作为防腐剂的是
A. 醋酸氢化可的松微晶25g
B. 氯化钠8g
C. 吐温3.5g
D. 羧甲基纤维素钠5g
E. 硫柳汞0.01g/制成1000ml

正确答案：E。硫柳汞0.01g/制成1000ml

解析：本题考查液体制剂常用的附加剂。硫柳汞0.01g/制成1000ml（E对）用作防腐剂；氢化可的松（A错）为主药；氯化钠（B错）为渗透压调节剂；吐温（C错）即为聚山梨酯类，为常用的润湿剂；羧甲基纤维素钠（D错）为混悬剂。